Ⅲ型变态反应的重要病理学特征是
A. 嗜酸性粒细胞浸润
B. 单核细胞浸润
C. 充血、水肿、局部坏死和中性粒细胞浸润
D. 嗜碱性粒细胞浸润
E. 淋巴细胞浸润

正确答案：C。充血、水肿、局部坏死和中性粒细胞浸润